高血压患者遵从医嘱服药的强化因素是
A. 患者的经济条件足以支付较高的医药费
B. 患者对治疗高血压采取积极态度
C. 患者能方便地就医取药
D. 患者在按医嘱服药后血压得到有效控制
E. 患者知晓服药能有效控制血压

正确答案：D。患者在按医嘱服药后血压得到有效控制

解析：影响健康行为的因素分为：倾向因素、促成因素和强化因素。倾向因素（BE错）通常先于行为，是产生某种行为的动机或愿望，或是诱发产生某行为的因素，其中包括知识、信念、价值观、态度及自信心，以及现有技能、自我效能等。促成因素（AC错）是实现或达到某行为所必需的技术和资源。强化因素（D对）是指对象实施某行为后所得到的加强或减弱该行为的因素，这类因素来自行为者周围的人，也包括行为者自己对行为后果的感受，如社会效益（如得到尊重），生理效益（如通过体育锻炼后感到舒展有力、经治疗后痛苦缓解）、经济效益（如得到经济奖励或节省开支）、心理收益（如感到充实愉快）等。